《中国药典》规定，片重0.30g以下者其重量差异限度为
A. ±9.0％
B. ±7.5％
C. ±5.0％
D. ±4.5％
E. ±6.0％

正确答案：B。±7.5％